某男，25岁。症见咽痛、咽部红肿、糜烂、口腔溃疡久不收敛。宜选用的中成药是
A. 珠黄散
B. 六神丸
C. 清音丸
D. 清咽滴丸
E. 口炎清颗粒

正确答案：A。珠黄散

解析：本题考查珠黄散的主治。宜选用的中成药是珠黄散（A对）。珠黄散【主治】热毒内蕴所致的咽痛，咽部红肿、糜烂，口腔溃疡久不收敛。六神丸（B错）【主治】烂喉丹痧，咽喉肿痛，喉风喉痈，单双乳蛾，小儿热疖，痈疡疔疮，乳痈发背，无名肿毒。清音丸（C错）【主治】肺热津亏，咽喉不利，口舌干燥，声哑失音。清咽滴丸（D错）【主治】外感风热所致的急喉痹，症见咽痛、咽干、口渴，或微恶风、发热、咽部红肿，舌边尖红、苔薄白或薄黄、脉浮数或滑数；急性咽炎见上述证候者。口炎清颗粒（E错）【主治】阴虚火旺所致的口腔炎症。